假阳性率的大小
A. 与实际有病者有关
B. 与实际无病者有关
C. 与实际无病者无关
D. 与实际无病者无关
E. 与实际有病无病者均无关

正确答案：B。与实际无病者有关